临床上癫痫发作与假性癫痫发作的主要鉴别为发作时有
A. 全身抽搐
B. 突然跌倒
C. 呼吸急促，喉中发出叫声
D. 双手紧握，下肢僵直
E. 伴瞳孔散大，对光反应消失

正确答案：E。伴瞳孔散大，对光反应消失

解析：癫痫是多种原因导致的脑部神经元高度同步化放电所致的临床综合征，有多种发作形式，可发生在任何场合，发作特点为突然刻板性发作。临床表现为突然跌倒，可摔伤，全身抽搐，双手紧握，呼吸加深加快，伴有瞳孔散大、对光反射消失；而假性癫痫发作是由心理障碍而非脑电紊乱引起的脑部功能异常，多有精神诱因或有人在场时发作，发作形式多样，可突然跌倒（B错），但不会摔伤，全身抽搐（A错），手足抽动且双手紧握（D错），呼吸急促（C错），眼睑紧闭，眼球乱动，但瞳孔大小正常，对光反射存在，故癫痫发作与假性癫痫发作的主要鉴别点是瞳孔是否散大，对光反射是否存在（E对）。